某女，48岁，患更年期综合征2年，症见烘热汗出，心烦易怒，少寐健忘，头晕耳鸣，口渴咽干，四肢酸楚。证属肝肾阴虚，宜选用的成药是
A. 坤宝丸
B. 宫血宁胶囊
C. 乌鸡白凤丸
D. 益母草颗粒
E. 妇科十味片

正确答案：A。坤宝丸

解析：本题考查的是坤宝丸的主治。患更年期综合征2年，症见烘热汗出，心烦易怒，少寐健忘，头晕耳鸣，口渴咽干，四肢酸楚。证属肝肾阴虚，宜选用的成药是坤宝丸（A对）。坤宝丸：【主治】肝肾阴虚所致的绝经前后诸证，症见烘热汗出、心烦易怒、少寐健忘、头晕耳鸣、口渴咽干、四肢酸楚；更年期综合征见上述证候者。宫血宁胶囊（B错）：【主治】血热所致的崩漏下血、月经过多，产后或流产后宫缩不良出血及子宫功能性出血，以及慢性盆腔炎属湿热瘀结所致者，症见少腹痛、腰骶痛、带下增多。乌鸡白凤丸（C错）：【主治】气血两虚，身体瘦弱，腰膝酸软，月经不调，崩漏带下。益母草颗粒（D错）：【主治】血瘀所致的月经不调、产后恶露不绝，症见经水量少、淋沥不净，产后出血时间过长；产后子宫复旧不全见上述证候者。妇科十味片（E错）：【主治】血虚肝郁所致的月经不调、痛经、月经前后诸证，症见行经后错，经水量少、有血块，行经小腹疼痛，血块排出痛减，经前双乳胀痛、烦躁，食欲不振。